物质环境因素对健康影响，按有害物的性质可分为
A. 生物因素、化学因素和物理因素
B. 来自自然环境中的各类物质、来自工业生产的有害物质
C. 来自自然环境中的各类物质、来自农业耕种等条件下产生的各种有害因素
D. 家庭、学校、工作场所和社区
E. 呼吸道吸入、消化道消化吸收、皮肤渗入和被咬伤

正确答案：A。生物因素、化学因素和物理因素

解析：本题考查预防医学概论、健康及三级预防策略。物质环境因素对健康影响的分类：①按有害物的性质分为生物因素、化学因素和物理因素（A对）；②按物质的来源分为来自自然环境中的各类物质、来自工业生产的有害物质（B错），以及在农业耕种等条件下产生的各种有害因素（C错）；③按所存在的载体分为空气、水、土壤和食物中的各类有害物质；④按接触的地点分为家庭、学校、工作场所和社区（D错）；⑤按接触的途径分为呼吸道吸入、消化道消化吸收、皮肤渗入和被咬伤等（E错）。